左旋多巴抗帕金森病的特点是
A. 1～2周起效
B. 对重症帕金森病疗效好
C. 对肌肉强直效果好
D. 对震颤疗效好
E. 用于氯丙嗪引起的锥体外系症状

正确答案：C。对肌肉强直效果好

解析：左旋多巴抗帕金森病的特点为：①疗效与黑质-纹状体多巴胺能神经变性严重程度有关，对轻症及年轻患者疗效较好，而对重症及年老患者疗效较差（B错）。②对肌肉强直及运动徐缓患者疗效较好（C对），而对肌肉震颤患者疗效较差（D错），这可能与肌肉震颤患者同时伴有5-HT能神经功能紊乱有关。③起效慢，用药初期疗效显著。用药2～3周后患者体征明显改善（A错），用药1～6个月后可获得最大疗效。但3～5年后疗效已不显著，其原因可能与黑质-纹状体多巴胺能神经进行性变性、缺失，受体下调或其他补偿机制有关。苯海索对由抗精神病药如氯丙嗪等引起的锥体外系不良反应有效（E错）。